二甲双胍的最佳服用时间是
A. 餐前
B. 清晨空腹
C. 餐中
D. 餐后
E. 睡前

正确答案：C。餐中

解析：本题考查药品服用的适宜时间。二甲双胍的最佳服用时间是餐中（C对），可减少对胃肠道的刺激和不良反应。适宜于清晨空腹（B错）服用的药物大多要保证对胃肠道无强烈的刺激性，同时可避免食物影响药效，利于药物被吸收和发挥作用，如补益类中药、泻药和某些抗生素等。适宜餐前（A错）服用的药物多可充分附着于肠壁，促进胃蠕动、助消化，需进入小肠作用，避免刺激食管和胃，使血药峰值提前或避免进食延缓药物吸收，如胃黏膜保护药和促胃动力药等。适宜餐后（D错）服用的药物可减少对胃肠的刺激或缓慢进入小肠以利于吸收，如阿司匹林、对乙酰氨基酚和维生素B₁等。适宜睡前（E错）服用的药物有催眠药、平喘药、调节血脂药、抗过敏药、缓泻药等。